患者带下赤白，质稍黏，无臭，阴部灼热，头晕耳鸣，舌红少苔，脉细数。其治法是
A. 脾益气，升阳除湿
B. 温肾培元，固涩止带
C. 益肾滋阴，清热止带
D. 清利湿热止带
E. 清热解毒止带

正确答案：C。益肾滋阴，清热止带

解析：患者带下量多为主症，诊断为带下过多；阴虚生内热，则阴部灼热感，头晕耳鸣，舌红少苔，脉细数是肾阴虚之征，因此应当益肾滋阴，清热止带（C对）。健脾益气，升阳除湿以治疗带下过多脾阳虚证（A错）。温肾培元，固涩止带以治疗带下过多肾阳虚证（B错）。清热利湿止带以治疗带下过多湿热下注证（D错）。清热解毒止带以治疗带下过多热毒蕴结证（E错）。